重度烧伤是指3度烧伤面积
A. 不足10%
B. 10～19%
C. 20～29%
D. 30～39%
E. 0.04

正确答案：B。10～19%

解析：重度烧伤：烧伤总面积31%～50%；或Ⅲ⁰烧伤面积11%～20%（B对）；或Ⅱ⁰、Ⅲ⁰烧伤面积虽不到上述百分比，但已发生休克等并发症，或存在较重的吸入性损伤、复合伤等。Ⅲ⁰烧伤面积不足10%（A错）为中度烧伤。Ⅲ⁰烧伤面积20%以上（CDE错）为特重度烧伤。